“重阴必阳，重阳必阴”说明了阴阳之间的哪种关系
A. 相互交感
B. 对立制约
C. 互根互用
D. 消长平衡
E. 相互转化

正确答案：E。相互转化

解析：本题考查阴阳之间的关系，属于理解记忆内容。阴阳转化，指事物的总体属性，在一定条件下可以向其相反的方向转化，即属阳的事物 可以转化为属阴的事物，属阴的事物可以转化为属阳的事物。《内经》以“重阴必阳，重阳必阴”、“寒极生热，热极生寒”（《素问·阴阳应象大论》）和 “物生谓之化，物极谓之变”(《素问·天元纪大论》)来阐释阴阳转化的机理（E对）。阴阳交感，是指明阳二气在运动中相互感应而交合，亦即相互发生作用（A错）。阴阳对立制约，是指属性相反的阴阳双方在一个统一体中的相互斗争、相互制约和相互排斥（B错）。阴阳互根广是指一切事物或现象中相互对立着的阴阳两个方面，具有相互依存，互为根 本的关系（C错）。阴阳消长，是指对立互根的阴阳双方不是一成不变的，而是处于不断的增长和消减的变 化之中。阴阳双方在彼此消长的运动过程中保持着动态平衡（D错）。